男性，62岁，近三个月逐渐出现上腹部不适，进食后饱胀，嗳气，纤维胃镜发现大弯侧胃壁上1cm大小块状肿物，与周围组织界限不清，病理回报恶性。该肿瘤Borrmann分型
A. Ⅲ型
B. Ⅳ型
C. Ⅴ型
D. Ⅱ型
E. Ⅰ型

正确答案：A。Ⅲ型

解析：患者老年男性，纤维胃镜发现大弯侧胃壁上1cm大小块状肿物，与周围组织界限不清（浸润生长），病理回报恶性，结合患者病史、检查，诊断考虑为进展期胃癌。肿瘤为大小1cm肿物、边界不清，Borrmann分型为Ⅲ型（A对）。Ⅰ型（E错）、Ⅱ型（D错）边界清楚。Ⅳ型（B错）为弥漫浸润。Borrmann分型无Ⅴ型（C错）。